主要由肿瘤性肌上皮细胞和肿瘤性导管上皮细胞构成、其特征是细胞形态的一致性、组织结构的多样性及浸润性生长方式的恶性肿瘤是
A. 恶性多形性腺瘤
B. 腺泡细胞癌
C. 黏液表皮样癌
D. 腺样囊性癌
E. 多形性低度恶性腺癌

正确答案：E。多形性低度恶性腺癌

解析：多形性低度恶性腺癌，光镜观察，多形性低度恶性腺癌的特征是细胞形态的一致性、组织结构的多样性及浸润性生长方式。掌握“腺泡细胞癌”知识点。